西酞普兰抗抑郁的药理作用机制是
A. 抑制5-羟色胺再摄取
B. 抑制神经末梢突触的α₂受体
C. 抑制5-羟色胺及去甲肾上腺素再摄取
D. 抑制单胺氧化酶
E. 阻断5-羟色胺受体及抑制5-羟色胺再摄取

正确答案：A。抑制5-羟色胺再摄取

解析：本题考查西酞普兰。西酞普兰抗抑郁的药理作用机制是抑制5-羟色胺再摄取（A对）。西酞普兰属于选择性5-羟色胺再摄取抑制剂，物主要通过选择性抑制5-HT的再摄取，增加突触间隙5-HT浓度，从而增强中枢5-HT能神经功能，发挥抗抑郁作用。抑制神经末梢突触的α₂受体（B错）的是去甲肾上腺素能及特异性5-HT能抗抑郁药，如米氮平。抑制5-羟色胺及去甲肾上腺素再摄取（C错）的是5-HT及去甲肾上腺素再摄取抑制剂（SNRI），如文拉法辛。抑制单胺氧化酶（D错）的是单胺氧化酶抑制剂，如吗氯贝胺。阻断5-羟色胺受体及抑制5-羟色胺再摄取（E错）的是曲唑酮抗抑郁的药理作用机制。